某中年人，童年生活受挫折，个性克制，情绪压抑，经常焦虑抑郁，又不善于宣泄，过分谨慎，强求合作调和。他的行为模式最容易患的躯体疾病是
A. 冠心病
B. 脑出血
C. 慢性结肠炎
D. 甲状腺功能亢进
E. 癌症

正确答案：E。癌症

解析：C型行为第六版医学心理学未详细论述，查找资料得知，C型行为主要表现为过度压抑情绪，尤其是不良的情绪，如愤怒、悲伤等，不让它们得到合理的舒泄。本题患者个性克制，情绪压抑，属于典型的C型行为模式，是容易使人患癌症（E对）的心理行为模式。A型行为模式表现为有较高的成就欲望，富于挑战和竞争精神，容易发生无端敌意，争强好胜，不耐烦，有时间紧迫感等，是冠心病（A错）发病的高危因素。脑出血（B错）、慢性结肠炎（C错）、甲状腺功能亢进（D错）的发病与行为模式无必然联系。